结核杆菌主要的致病物质是
A. 内毒素
B. 外毒素
C. 脂质
D. 荚膜多糖
E. 侵袭性酶

正确答案：C。脂质